疑为垂体腺瘤时，定位诊断首选
A. 脑电图
B. CT
C. MRI
D. 放射性核素扫描
E. 脑血管造影

正确答案：C。MRI

解析：疑为垂体腺瘤时，首选的定位检查是头颅MRI（C对）。